乳牙龋齿治疗原则如下，除外
A. 降低咬合高度
B. 去除病变组织
C. 恢复牙体外形
D. 提高咀嚼功能
E. 利于恒牙列的形成

正确答案：A。降低咬合高度

解析：本题考查乳牙龋病的治疗。乳牙龋齿治疗原则如下，除外降低咬合高度（A错，为本题的正确答案）。降低咬合高度是针对根尖周病咬合痛采取的措施，对于龋病没有任何治疗作用。病变组织内含致龋菌、毒素等，必须去除病变组织（B对），终止龋的发展，消除致病因素；同时要恢复牙体的外形（C对），以提高咀嚼功能（D对）、利于发音和美观，维护牙列的完整性，使乳牙能正常的被替换，利于恒牙列的形成（E对）。